下列何淋巴结称为Virchow淋巴结
A. 右锁骨上淋巴结
B. 左锁骨上淋巴结
C. 斜角肌淋巴结
D. 左斜角肌淋巴结
E. 无

正确答案：D。左斜角肌淋巴结

解析：沿颈横血管分布的淋巴结称锁骨上淋巴结 （AB错）, 其中位于前斜角肌前方的淋巴结称斜角肌淋巴结（C错），左侧斜角肌淋巴结（D对）又称 Virchow 淋巴结。